呕吐的治疗原则是
A. 健脾化湿
B. 温养脾胃
C. 补中益气
D. 养阴和胃
E. 和胃降逆

正确答案：E。和胃降逆

解析：呕吐总的病机因胃气上逆所致，故治以和胃降逆为原则，结合具体症状辨证论治（E对）。